同时抑制5-HT及去甲肾上腺素(NE）再摄取而起到抗抑郁作用的药物是
A. 马普替林
B. 度洛西汀
C. 帕罗西汀
D. 吗氯贝胺
E. 米氮平

正确答案：B。度洛西汀

解析：本题考查度洛西汀。同时抑制5-HT及去甲肾上腺素（NE）再摄取而起到抗抑郁作用的药物是度洛西汀（B对）。度洛西汀为5-HT及去甲肾上腺素再摄取抑制剂（SNRI），主要通过抑制5-HT及去甲
肾上腺素再摄取，增强中枢5-HT能及NE能神经功能而发挥抗抑郁作用。马普替林（A错）是四环类抗抑郁药，通过抑制突触前膜对去甲肾上腺素的再摄取，增强中枢去甲肾上腺素能神经的功能，从而发挥抗抑郁作用。帕罗西汀（C错）是选择性5-羟色胺再摄取抑制剂（SSRI），主要通过选择性抑制5-HT的再摄取，增加突触间隙5-HT浓度，从而增强中枢5-HT能神经功能，发挥抗抑郁作用。吗氯贝胺（D错）是单胺氧化酶抑制剂，本类药通过抑制A型单胺氧化酶，减少去甲肾上腺素、5-HT及多巴胺的降解，增强去甲肾上腺素、5-HT和多巴胺能神经功能，而发挥抗抑郁作用。米氮平（E错）是去甲肾上腺素能及特异性5-HT能抗抑郁药，主要通过阻断中枢NE能和5-HT能神经末梢突触前α₂受体，增加NE和5-HT的间接释放，增强中枢NE能及5-HT能神经的功能，并阻断5-HT₂、5-HT₃受体以调节5-HT₁功能，从而达到抗抑郁作用。